下列哪项不是肺胀的常见临床表现
A. 长期反复咳咳嗽
B. 喘息，气短难续
C. 痰涎壅盛
D. 胸中胀满
E. 唇暗舌紫，脉结代

正确答案：E。唇暗舌紫，脉结代

解析：肺胀是由于肺失肃降所致，有虚实之分。实证多因邪气壅肺，肺气不降；虚证多因肺肾两虚，导致肾不纳气，肺气上逆。肺气上逆，气机不利故见长期反复咳嗽（A对）、喘息。肾虚不能纳气，故见气短难续（B对）。肺气不利，气滞痰壅故见痰涎壅盛（C对）。邪气壅肺，肺气不降故见胸中胀满（D对）。唇暗舌紫，脉结代为血瘀之象，与肺胀的病因无关（E错，为本题正确答案）。